治疗老年性骨质疏松症的常用药物包括
A. 钙制剂
B. 维生素D
C. 维生素E
D. 阿仑膦酸钠
E. 左甲状腺素钠

正确答案：A、B、D。钙制剂；维生素D；阿仑膦酸钠

解析：本题考查骨质疏松症的药物治疗。钙制剂（A对）、维生素D（B对）、阿仑膦酸钠（D对）的三联药物是治疗老年性骨质疏松症的公认方案。维生素E（C错）为抗氧化剂。左甲状腺素钠（E错）是甲状腺激素缺乏的治疗药物。